狭义的健康管理的宗旨是
A. 对各种健康危险因素进行系统干预和管理
B. 向人们提供有针对性的健康咨询和指导服务
C. 获取最大的健康效果
D. 实现对群体健康危险因素及不良社会环境因素的监测、分析、评价和干预
E. 实现所有环境中促进和改善健康的目标

正确答案：C。获取最大的健康效果

解析：本题考查狭义的健康管理宗旨。狭义上的健康管理宗旨是更好地调动和整合个人、集体和社会的健康管理资源和行动，通过有效的计划、组织、协调和控制等管理活动来获取最大的健康效果（C对ABDE错）。